《中国药典》（一部）规定，穿心莲药材中叶不得少于
A. 0.1
B. 0.15
C. 0.2
D. 0.25
E. 0.3

正确答案：E。0.3

解析：本题考查的是全草类中药含叶量的检查。《中国药典》（一部）规定，穿心莲药材中叶不得少于30%（E对）。《中国药典》规定穿心莲药材中叶不得少于30%，薄荷药材中叶不得少于30%，广藿香药材中叶不得少于20%（C错）等，从而保证这些中药的总体质量。